关于急性化脓性腮腺炎的叙述，哪项是错误的
A. 病原菌主要是金黄色葡萄球菌
B. 肿胀以耳垂为中心
C. 腮腺导管口红肿，可挤压出脓液
D. 患者全身中毒症状明显
E. 局部皮肤红热及触痛不明显

正确答案：E。局部皮肤红热及触痛不明显

解析：急性化脓性腮腺炎的病原菌主要是金黄色葡萄球菌，链球菌及肺炎双球菌较少见。常表现为单侧受累，双侧同时发生者少见。发病急，早期症状轻微或不明显，特别是全身疾病及腹部外科手术后者，这些症状常被全身的严重病情所掩盖而被忽视。肿胀以耳垂为中心，局部皮肤红热现象显著，呈硬性浸润，触痛明显。有轻度开口困难，腮腺导管口红肿，轻轻按摩腺体可见脓液自导管口溢出，有时甚至可见脓栓堵塞于导管口。患者全身中毒症状明显，有高热、脉率和呼吸加快、白细胞总数增加、中性粒细胞比例显著上升、核左移，并可出现中毒颗粒。掌握“急性化脓性腮腺炎”知识点。